半夏的归经是
A. 心、脾、肾经
B. 肝、脾、肾经
C. 肺、胃、肾经
D. 心、肝、胃经
E. 肺、脾、胃经

正确答案：E。肺、脾、胃经

解析：半夏的药性是辛，温。有毒。归脾、胃、肺经（E对）。